脂肪酸合成过程中，脂酰基的载体是
A. CoA
B. 肉碱
C. ACP
D. 丙二酰CoA
E. 草酰乙酸

正确答案：C。ACP

解析：脂肪酸合成过程中，脂酰基的载体是ACP（C对）。软脂酸延长（P153）过程中酯酰基连接在CoASH（A错）上进行。肉碱（B错）转运长链酯酰CoA进入线粒体。丙二酰CoA（D错）是脂肪酸合成中第一步反应的产物。草酰乙酸（E错）不参与脂肪酸合成。